大便澄澈清冷、完谷不化的病机是
A. 感受外邪
B. 伤于饮食
C. 脾胃虚弱
D. 脾肾阳虚
E. 气阴两伤

正确答案：D。脾肾阳虚

解析：小儿泄泻发生的原因，以感受外邪、伤于饮食、脾胃虚弱为多见，若迁延不愈，久则伤阴耗气，出现气阴两伤的变证，其中感受外邪如暑热之邪可致湿热泻，其大便改变为大便水样，或蛋花汤样，感受风寒之邪，客于脾胃导致的风寒泻大便改变为大便清稀，夹有泡沫（A错）。伤于饮食导致的伤食泻大便改变为大便稀溏，夹有乳凝块或食物残渣（B错）。脾胃虚弱引起的脾虚泻大便改变为大便稀溏，色淡不臭（C错）。脾虚致泻者，耗伤脾气，继伤脾阳，日久则脾损及肾，造成脾肾阳虚，引起脾肾阳虚泻，大便改变为久泻不止，大便清稀，澄澈清冷、完谷不化（D对）。气阴两伤变证大便改变为泻下过度，质如稀水（E错）。